流行病学研究的基础是
A. 描述性研究
B. 分析性研究
C. 实验性研究
D. 理论性研究
E. 流行病学方法研究

正确答案：A。描述性研究

解析：本题考查描述性研究的地位。描述性研究（A对BCDE错）是流行病学研究方法中最基本的类型。